直接起于腹主动脉的有
A. 胃左动脉
B. 肝总动脉
C. 肠系膜上动脉
D. 胃右动脉
E. 无

正确答案：C。肠系膜上动脉

解析：肠系膜上动脉（C对）直接起于腹主动脉，为腹主动脉不成对的脏支。胃左动脉，胃右动脉，肝总动脉均为腹腔干的各级分支。